脐带中的静脉数是
A. 1条
B. 2条
C. 3条
D. 4条
E. 5条

正确答案：A。1条

解析：脐带断面中央有一条脐静脉，两侧有两条脐动脉。掌握“妊娠生理”知识点。